斜方肌瘫痪后，肩关节不能
A. 外展
B. 内收
C. 耸肩
D. 旋外
E. 旋内

正确答案：C。耸肩

解析：斜方肌瘫痪后，则产生“塌肩”，即肩关节不能耸肩（C对）。